《中国药典》规定，崩解时限为3分钟的是
A. 咀嚼片
B. 口崩片
C. 分散片
D. 舌下片
E. 口腔贴片

正确答案：C。分散片

解析：本题考查分散片的崩解时限。《中国药典》规定，崩解时限为3分钟的是分散片（C对）。分散片，照崩解时限检查法检查水温为15℃～25℃，供试品6片，各片应在3分钟内全部崩解并通过内径为710㎛的筛网。咀嚼片（A错）、以冷冻干燥法制备的口崩片以及规定检查溶出度、释放度的片剂，一般不再进行崩解时限检查。口崩片（B错）应在60秒内全部崩解并通过筛孔内径为710㎛的筛网。舌下片（D错），各片均应在5分钟内全部崩解并溶化。口腔贴片（E错）：系指粘贴于口腔，经黏膜吸收后起局部或全身作用的片剂。口腔贴片应进行溶出度或释放度检查。